血液流进左心室的入口是
A. 左肺静脉口
B. 上腔静脉口
C. 左房室口
D. 右房室口
E. 下腔静脉口

正确答案：C。左房室口

解析：左房室口（C对）为血液流进左心室的入口，周围有二尖瓣附着于二尖瓣环上。